根据《中华人民共和国药品管理法》，关于药品生产的说法，正确的是
A. 开办药品生产企业，应当经国家药品监督管理部门批准并发给《药品生产许可证》
B. 经县级以上药品监督管理部门批准，药品生产企业可以接受委托生产药品
C. 药品生产企业改变影响药品质量的生产工艺的，必须报原批准部审核批准
D. 经具有合法资格的药品生产企业之间协商一致，可以委托生产药品
E. 采用企业内定的中药饮片炮制规范炮制中药饮片

正确答案：C。药品生产企业改变影响药品质量的生产工艺的，必须报原批准部审核批准

解析：本题考查的是药品生产管理。根据《中华人民共和国药品管理法》，关于药品生产的说法，正确的是药品生产企业改变影响药品质量的生产工艺的，必须报原批准部审核批准（C对）。从事药品生产活动，应当经所在地省、自治区、直辖市药品监督管理部门批准，依照规定取得《药品生产许可证》（A错）。药品上市许可持有人依法自行生产或委托生产药品：上市许可持有人自行生产药品的，应当依照《药品管理法》规定取得药品生产许可证；委托生产的，应当委托符合条件的药品生产企业。药品上市许可持有人和受托生产企业应当签订委托协议和质量协议，并严格履行协议约定的义务（BD错）。血液制品、麻醉药品、精神药品、医疗用毒性药品、药品类易制毒化学品不得委托生产；但是，国务院药品监督管理部门另有规定的除外。国家药品标准的定义：国家药品标准是国家对药品质量要求和检验方法所做的技术规定，是药品生产、供应、使用、检验和管理共同遵循的法定依据。《药品管理法》规定，药品应当符合国家药品标准。经国务院药品监督管理部门核准的药品质量标准高于国家药品标准的，按照经核准的药品质量标准执行；没有国家药品标准的，应当符合经核准的药品质量标准。国务院药品监督管理部门颁布的《中华人民共和国药典》和药品标准为国家药品标准。《药品管理法》还规定，中药饮片必须按照国家药品标准炮制；国家药品标准没有规定的，必须按照省级药品监督管理部门制定的炮制规范炮制（E错）。省级药品监督管理部门制定的炮制规范应当报国家药品监督管理部门备案。